以下不属于根尖周病按其病理变化和临床表现形式的分型是
A. 根尖周脓肿
B. 根尖周囊肿
C. 根尖周骨硬化症
D. 根尖周肉芽肿
E. 急性根尖周炎浆液期

正确答案：E。急性根尖周炎浆液期

解析：根据其病理变化和临床表现形式，可分为四型：根尖周肉芽肿；根尖周脓肿；根尖周囊肿；根尖周致密性骨炎，又称根尖周骨硬化症。掌握“根尖周病概述”知识点。